邻（牙合）面洞的邻面颊、舌壁要求是
A. 相互平行
B. 与颈壁垂直
C. 稍外敞
D. 颈外敞

正确答案：C。稍外敞

解析：本题考查Ⅱ类洞预备要点。由于牙齿邻面的釉质走向为表面分散内侧稍聚合，因此邻（牙合）面洞的邻面颊、舌壁预备时应稍外敞（C对），以减少无基釉形成。Ⅱ类洞预备时，邻面为正梯形。颊舌壁相互平行会形成无基釉（A错），在牙齿承受侧向力时易折裂。邻（牙合）面洞邻面制备成龈方大于（牙合）方的梯形，防止充填体垂直方向脱位，颊舌壁与颈壁垂直呈锐角，而不是与颈壁平行（B错）。邻（牙合）面洞邻面颈部应与牙长轴垂直，可制备出潜凹，增加修复体固位，颈部不能外敞（D错）否则会影响修复体的固位。